动脉粥样硬化的纤维斑块是
A. 细胞水肿
B. 脂质沉积
C. 结缔组织玻璃样变
D. 血管壁玻璃样变
E. 细胞内玻璃样变

正确答案：C。结缔组织玻璃样变

解析：动脉粥样硬化的纤维斑块属于结缔组织的玻璃样变（C对），是纤维组织老化的表现，其特点是陈旧的胶原纤维增粗并互相融合成均质红染的梁状、带状或片状，失去纤维性结构。细胞水肿（A错）又称水样变（P15），是指因胞质内离子浓度调节功能障碍导致细胞内大量水分蓄积的现象。脂质沉积（B错）于非脂肪细胞可引起脂肪变性，多发生于肝细胞。血管壁玻璃样变（P17）（D错）和细胞内玻璃样变（P16）（E错）是玻璃样变的另外两种的类型，前者常见于缓进型高血压等；后者常见于酒精性肝病等。